牙齿萌出的生理特点哪项是错误的
A. 在一定时间内萌出
B. 同颌同名牙左侧萌出早于右侧
C. 下颌牙萌出早于上颌牙
D. 男女同龄人萌出情况不相同
E. 按一定顺序先后萌出

正确答案：B。同颌同名牙左侧萌出早于右侧

解析：本题考查牙齿萌出的生理特点。牙齿萌出的生理特点错误的是同颌同名牙左侧萌出早于右侧（B错,为本题的正确答案）。牙齿萌出的生理特点是在一定时间内（A对），按照一定顺序先后萌出（E对），同颌同名牙左右成对萌出；一般情况下，下颌牙萌出早于上颌牙（C对）；女性同名牙的萌出早于男性（D对）。乳牙萌出顺序为：乳中切牙—乳侧切牙—第一乳磨牙—乳尖牙—第二乳磨牙；恒牙萌出顺序，上颌多为6—1—2—4—3—5—7或6—1—2—4—5—3—7；下颌多为6—1—2—3—4—5—7或6—1—2—4—3—5—7。